下列方剂中，不含附子的是
A. 实脾散
B. 真武汤
C. 乌梅丸
D. 温脾汤
E. 阳和汤

正确答案：E。阳和汤

解析：实脾散（A错）组成是厚朴、白术、木瓜、木香、草果仁、大腹子、附子、白茯苓、干姜、甘草、生姜、大枣（实脾苓术与木瓜，甘草木香大腹加，草果姜附兼厚朴，虚汗阴水效堪夸）。真武汤（B错）组成是茯苓、芍药、白术、生姜、附子（真武汤壮肾中阳，茯苓术芍附生姜）。乌梅丸（C错）组成是乌梅、细辛、干姜、黄连、当归、附子、蜀椒、桂枝、人参、黄柏（乌梅丸用细辛桂，黄连黄柏及当归，人参附子椒姜继，温脏安蛔寒厥剂）。温脾汤（D错）组成是当归、干姜、附子、人参、芒硝、大黄、甘草（温脾参附与干姜，甘草当归硝大黄，寒热并用治寒疾，脐腹绞结痛非常）。阳和汤（E对）组成是熟地黄、麻黄、鹿角胶、白芥子、肉桂、生甘草、炮姜（阳和汤法解寒凝，贴骨流注鹤膝风，熟地鹿胶姜炭桂，麻黄白芥甘草从），方中不含附子。